太渊穴主治的病证是
A. 咳喘，口㖞
B. 咳嗽，无脉症
C. 瘾疹，湿疹
D. 无汗，多汗
E. 惊悸，怔忡

正确答案：B。咳嗽，无脉症

解析：该题主要考察腧穴的主治，是记忆类题目。太渊是手太阴肺经腧穴，主治咳嗽、气喘等肺系病证，无脉症，腕臂痛（B对）。